与系统性红斑狼疮患者发生雷诺现象相关的自身抗体是
A. 抗Sm抗体
B. 抗RNP抗体
C. 抗DsDNA抗体
D. 抗SSA抗体
E. 抗ANA抗体

正确答案：B。抗RNP抗体

解析：与系统性红斑狼疮患者发生雷诺现象相关的自身抗体是抗RNP抗体（B对），同时也与肌炎相关。抗Sm抗体（A错）为诊断SLE的标记抗体之一，用于早期诊断或回顾性诊断。抗DsDNA抗体（C错）为SLE的标记抗体之一，其滴度与疾病活动性相关。抗SSA抗体（D错）与SLE患者的光过敏、血管炎、皮损、白细胞减低等相关。抗ANA抗体（E错）见于所有SLE患者，但其特异性低。